眶下孔位于上颌骨的
A. 前外面
B. 颞下面
C. 眶面
D. 鼻面
E. 内面

正确答案：A。前外面

解析：上颌体：略呈锥体形，分为前、后、上、内四面，中央有上颌窦。前外面有眶下孔、尖牙窝，眶下孔位于眶下缘中点下方约0.5cm处，孔内有眶下神经、血管通过，是眶下神经阻滞麻醉的有效注射部位。掌握“面部表面解剖”知识点。